治疗胆结石兼消化不良，应选用的药物是
A. 香附
B. 麦芽
C. 鸡内金
D. 山楂
E. 莱菔子

正确答案：C。鸡内金

解析：鸡内金的功效为健胃消食，涩精止遗，通淋化石。鸡内金消食化积作用较强，并可健运脾胃，可广泛治疗各种食积证；鸡内金亦有化坚消石及通淋之功，可用于治疗石淋涩痛（C对）。香附的功效为疏肝解郁，理气宽中，调经止痛。治疗肝郁气滞，胸胁胀痛，疝气疼痛；肝郁气滞，月经不调，经闭痛经，乳房胀痛；脾胃气滞，脘腹痞闷，胀满疼痛（A错）。麦芽的功效为行气消食，健脾开胃，回乳消胀。治疗食积不化，脘腹胀满，脾虚食少；乳汁郁积，乳房胀痛，妇女断乳；肝郁胁痛，肝胃气痛（B错）。山楂的功效为消食健胃，行气散瘀，化浊降脂。治疗肉食积滞，胃脘胀满，腹痛泄泻；泻痢腹痛，疝气疼痛；血瘀经闭痛经，产后瘀阻腹痛，心腹刺痛，胸痹心痛；高脂血症（D错）。莱菔子的功效为消食除胀，降气化痰。治疗饮食停滞，脘腹胀痛，大便秘结，积滞泻痢；痰壅气逆，喘咳痰多，胸闷食少（E错）。